慢性肾衰竭的中医根本病机是
A. 饮食不当，痰湿内阻
B. 肾元虚衰，湿浊内蕴
C. 肾病日久，瘀血阻络
D. 感受外邪，热毒侵袭
E. 劳倦内伤，脾肾两虚

正确答案：B。肾元虚衰，湿浊内蕴

解析：慢性肾衰竭的发生是各种因素导致肾元虚衰，湿浊内蕴（B对）。感受外邪、饮食不当、劳倦过度、药毒伤肾、劳伤久病等都是导致发生慢性肾衰竭的因素，但并非根本病机（ACDE错）。